蛋白质INQ≥1的食物，说明该食物
A. 蛋白质含量高
B. 蛋白质含量低
C. 能量高
D. 能量低
E. 蛋白质营养价值高

正确答案：E。蛋白质营养价值高